具有高等学校医学专业本科学历，考到执业医师资格证不做医生后，执业医师资格证保留年限为
A. 3年
B. 5年
C. 1年
D. 4年
E. 2年

正确答案：E。2年

解析：具有高等学校医学专业本科学历，考到执业医师资格证不做医生后，执业医师资格证保留年限为2年（E对）。